腭中缝裂开属于
A. LeFortⅠ型骨折
B. LeFortⅡ型骨折
C. LeFortⅢ型骨折
D. 横断形、分离性骨折
E. 纵行骨折

正确答案：E。纵行骨折

解析：由于暴力的种类及方向不同，上颌骨骨折的骨折线不一定都是如上所述的两侧对称性同时骨折。可发生单侧上颌骨骨折或两侧骨折线不在同一平面。此外，还可发生上颌骨矢状骨折，如腭中缝矢状骨折。掌握“牙槽突骨折、颌骨骨折”知识点。